有腱划的肌是
A. 腹外斜肌
B. 腹内斜肌
C. 腹横肌
D. 腹直肌
E. 缝匠肌

正确答案：D。腹直肌

解析：有腱划的肌是腹直肌（D对）。